多巴胺最适用于治疗的是
A. 伴有心肌收缩力减弱、尿量减少而血容量已补足的休克病人
B. 青霉素G引起的过敏性休克
C. 心源性哮喘
D. 支气管哮喘
E. 缓慢型心律失常

正确答案：A。伴有心肌收缩力减弱、尿量减少而血容量已补足的休克病人

解析：多巴胺是去甲肾上腺素生物合成的前体，主要激动α、β受体以及外周多巴胺受体，大剂量可激动心脏β₁受体，使心肌收缩力加强，心输出量增加，小剂量时与肾脏、肠系膜、冠脉的D₁结合，促进血管舒张，大剂量时激动血管α受体，血管收缩，外周阻力增加，临床主要用于治疗各种休克，如心源性休克、感染性休克等，尤适用于伴有心肌收缩力减弱、尿量减少而血容量已补足的休克（A对）。肾上腺素可激动α受体，收缩小动脉和毛细血管，消除黏膜水肿，激动β受体，改善心功能，升高血压，缓解支气管痉挛，减少过敏介质的释放，迅速缓解过敏性休克的症状，可用于青霉素G引起的过敏性休克（B错）。吗啡可用于治疗心源性哮喘（C错）。肾上腺素激动药可激动支气管平滑肌β₂受体，扩张支气管平滑肌，临床常用的此类药物主要有异丙肾上腺素、沙丁胺醇等，多巴胺缺乏选择性不用于支气管哮喘（D错）。阿托品属于M受体阻断剂，可用于治疗迷走神经过度兴奋所致窦房阻滞、房室阻滞等缓慢型心律失常（E错）。